眼动脉
A. 发源于颈内动脉
B. 经视神经管入眶
C. 其分支有视网膜中央动脉
D. 营养眶内结构等
E. 以上都正确

正确答案：E。以上都正确

解析：眼动脉发源于颈内动脉（A对），经视神经管入眶（B对），其分支有视网膜中央动脉（C对），营养眶内结构等（D对），故选择“以上都正确（E对）”。